正确描述胸锁关节的是
A. 是上肢与躯干连结的关节之一
B. 由胸骨的锁切迹、锁骨的胸骨端和第l肋软骨的上缘构成
C. 由锁骨胸骨端与胸骨的锁切迹构成
D. 属于球窝关节
E. 仅前方有韧带加强

正确答案：B。由胸骨的锁切迹、锁骨的胸骨端和第l肋软骨的上缘构成

解析：上肢骨与躯干骨仅有一处连结（A错），即为胸锁关节。胸锁关节属于多轴关节（D错），由锁骨的胸骨端与胸骨的锁切迹及第一肋软骨的上面构成（B对C错），并由胸锁前、后韧带，锁间韧带、肋锁韧带等外韧从前方、后方（E错）等处加强。